水痘最常见的并发症为
A. 脑炎
B. 败血症
C. 皮肤继发细菌感染
D. 双侧视神经损伤
E. 心肌炎

正确答案：C。皮肤继发细菌感染

解析：水痘最常见的并发症为皮肤继发细菌感染（C对），严重时有发生败血症的可能（B错），神经系统可见水痘后脑炎（A错），少数病例可发生心肌炎（E错），但均不是最常见的并发症，9版教材未提及水痘并发的双侧视神经损伤（D错）。